晚期日本血吸虫病的临床分型不包栝
A. 结肠肉芽肿型
B. 侏儒型
C. 巨脾型
D. 腹水型
E. 脑病型

正确答案：E。脑病型

解析：晚期日本血吸虫病的临床分型包括巨脾型（C对）、腹水型（D对）、结肠肉芽肿型（A对）和侏儒型（B对），不包括脑病型（E错，为本题正确答案）。